甲氨蝶呤+醛氢叶酸，合并用药的目的是
A. 提高药物疗效
B. 减少不良反应
C. 治疗多种疾病
D. 延缓细菌耐药
E. 减少经济负担

正确答案：A。提高药物疗效